外伤性颅内血肿的主要致命因素是
A. 急性脑受压所致脑疝
B. 弥漫性脑水肿
C. 昏迷所致肺部感染
D. 脑脊液循环受阻
E. 蛛网膜下腔出血

正确答案：A。急性脑受压所致脑疝

解析：外伤性颅内血肿可压迫脑组织，引起颅内压明显增高，颅内产生压力梯度，形成脑疝（A对），从而严重危及患者生命。弥漫性脑水肿（B错）、脑脊液循环受阻（D错）为颅内血肿的继发性损伤，可引起弥漫性颅内压增高，一般不危及生命；昏迷所致肺部感染（C错）为严重颅脑损伤的最常见的并发症；蛛网膜下腔出血（E错）主要见于颅内动脉瘤破裂或畸形脑血管破裂，以偏瘫、视力视野障碍为主要临床表现。